患者心悸气短1年，劳累后加重。检查：脉搏80次/分，节律不规整，心率约110次/分，心律完全不规则，心音强弱绝对不一致。此患者心律失常的类型是
A. 窦性心律不齐
B. 窦性心动过速
C. 过早搏动
D. 心房纤维颤动
E. 室上性心动过速

正确答案：D。心房纤维颤动

解析：患者脉搏80次/分，节律不规整，心率约110次/分，心律完全不规则，心音强弱绝对不一致此患者心律失常的类型是心房纤维颤动。心房颤动减低了心脏泵血的效力，因为心房快速收缩，使得泵出的血液太少。结果是心室中充满血液的时间变短了，而心房与心室的行动无法协调一致（D对）。当窦房结产生冲动的频率不固定时，则称为窦性心律不齐。窦性心律不齐多见于年轻人群（A错）。在成年人当由窦房结所控制的心律其频率超过每分钟100次时称为窦性心动过速（B错）。早搏是指异位起搏点发出的过早冲动引起的心脏搏动，为最常见的心律失常。可发生在窦性或异位性（如心房颤动）心律的基础上。可偶发或频发，可以不规则或规则地在每一个或每数个正常搏动后发生，形成二联律或联律性过早搏动（C错）。室上性心动过速是心动过速的起始和终止常较突然，发作在无器质性心脏病的年轻患者，频率<200次/分，且持续时间较短的，大多仅有突然心悸感，有时伴恐惧、不安和多尿，在有器质性心脏病基础的患者，频率>200次/分，且持续时间较久的，可引起心脑等器官供血不足，导致血压下降、头晕、黑蒙、心绞痛、心力衰竭等（E错）。